高温烹调过程中易产生杂环胺类化合物的食品富含
A. 蛋白质
B. 脂肪
C. 淀粉
D. 维生素
E. 水

正确答案：A。蛋白质

解析：本题考查杂环胺类化合物的污染。在烹调温度、时间和水分相同的情况下，蛋白质（A对BCDE错）含量较高的食物产生杂环胺较多，而且蛋白质的氨基酸构成也直接影响所产生杂环胺的种类。